房颤可出现的脉搏
A. 水冲脉
B. 交替脉
C. 脉搏短绌
D. 重搏脉
E. 奇脉

正确答案：C。脉搏短绌

解析：房颤的典型临床表现为心音变化不定、心律极不规则和脉搏短绌（C对），脉搏短绌是由于许多心室搏动过弱以致未能开启主动脉瓣，或因动脉血压波太小，未能传导至外周动脉。水冲脉（A错）是由于周围血管扩张、血流量增大，或存在血液分流、反流所致，常见于甲亢、严重贫血、主动脉瓣关闭不全、先天性心脏病动脉导管未闭及动静脉瘘等；交替脉（B错）一般认为是左室收缩力强弱交替所致，是左室心力衰竭的重要体征之一；重搏脉（D错）指正常脉搏在其下降期中有一重复上升的脉搏，但较第一个波低，不能触及，常见于肥厚梗阻性心肌病、伤寒及长期发热使外周血管紧张度降低等；奇脉（E错）指吸气时脉搏明显减弱或消失，系左心室搏血量减少所致，多见于心包积液、重症哮喘等。